男，15岁。咽痛，发热1周，双下肢对称性紫癜伴腹痛及关节痛3天。实验室检查：血Hb125g/L，WBC10.5×10⁹/L，Plt110×10⁹/L，凝血时间正常，粪隐血（+）。首选的治疗措施是
A. 应用糖皮质激素
B. 应用抗纤溶药物
C. 输注血小板
D. 输注纯化凝血因子
E. 联合化疗

正确答案：A。应用糖皮质激素

解析：青少年男性，咽痛、发热（感染史），双下肢对称性紫癜、腹痛、关节痛，粪隐血（+）。最可能的诊断是过敏性紫癜。首选的治疗措施是应用糖皮质激素（A对）。主要用于关节肿痛、严重腹痛合并消化道出血及有急进性肾炎或肾病综合征等严重肾脏病变者。